下列各项，不属于百合固金汤药物组成的是
A. 熟地、生地、
B. 知母、沙参
C. 桔梗、玄参
D. 贝母、麦冬
E. 当归、百合

正确答案：B。知母、沙参

解析：本题考查方剂的组成，百合固金汤组成有熟地、生地、当归身、白芍、甘草、桔梗、玄参、贝母、麦冬、百合，没有知母、沙参（B对）。